孕妇患风疹后，可能引起胎儿畸形，此传播方式为
A. 上行性传播
B. 水平传播
C. 医源性传播
D. 垂直传播
E. 产时传播

正确答案：D。垂直传播